蜷卧缩足，喜加衣被的临床意义是
A. 虚寒证
B. 实热证
C. 虚热证
D. 血虚证
E. 气虚证

正确答案：A。虚寒证

解析：本题考查望态中的卧式。蜷卧缩足，喜加衣被者，多属虚寒证(A对）。仰卧伸足，掀去衣被，多属实热证（B错）。血虚证的临床表现为面色淡白或萎黄，眼脸、口唇、爪甲色淡，头晕眼花、心悸，失眠多梦，健忘，手足麻木，妇女经血量少色淡、延后甚或闭经，舌淡苔白，脉细无力（D错）。气虚证的临床表现为神疲乏力，少气懒言，气短，头晕目眩，自汗，动则诸症加剧，舌质淡嫩，脉虚（E错）。